可引起血清胆固醇和低密度脂蛋白增高的药物是
A. 呋塞米
B. 氢氯噻嗪
C. 螺内酯
D. 乙酰唑胺
E. 甘露醇

正确答案：B。氢氯噻嗪

解析：本题考查氢氯噻嗪的不良反应。氢氯噻嗪（B对）的不良反应为电解质紊乱、高尿酸血症、代谢变化（可导致高血糖，增加血清胆固醇和低密度脂蛋白），糖尿病和高血脂症患者慎用。